在Ⅰ型超敏反应中具有重要负反馈调节作用的细胞是
A. 嗜中性粒细胞
B. 嗜碱性粒细胞
C. 嗜酸性粒细胞
D. 单核吞噬细胞
E. 肥大细胞

正确答案：C。嗜酸性粒细胞

解析：Ⅰ型超敏反应在四型超敏反应中发生速度与最快，一般在第二次接触抗原后数分钟内出现临床症状，故也称速发型超敏反应。变应原是Ⅰ型超敏反的始动因素，肥大细胞（E错）和嗜碱性粒细胞（B错）表面表达高亲和性IgE Fc受体介导Ⅰ型超敏反发生。嗜酸性粒细胞（C对）释放组胺酶和芳基硫酸酯酶，灭活肥大细胞释放的组胺和LT，对Ⅰ型超敏反应起到一定的抑制作用。嗜中性粒细胞与Ⅲ型超敏反应有关（A错），在吞噬免疫复合物的同时，释放许多溶酶体酶，水解血管和局部组织。单核吞噬细胞与Ⅳ型超敏反应有关（D错），释放促炎症细胞因子如IL-1、IL-6等加重炎症反应。